含三氮唑结构的抗肿瘤药物是
A. 氟康唑
B. 克霉唑
C. 来曲唑
D. 利巴韦林
E. 阿昔洛韦

正确答案：C。来曲唑

解析：本题考查含三氮唑结构的抗肿瘤药物。来曲唑（C对）为含三氮唑结构的芳构酶抑制剂，可抑制肿瘤细胞的生长。氟康唑（A错）、克霉唑（B错）均为抗真菌药物。利巴韦林（D错）、阿昔洛韦（E错）均为抗病毒药物。